镰刀菌毒素主要污染的食品是
A. 玉米和花生
B. 大豆和可可豆
C. 小麦和玉米
D. 大米
E. 山楂汁和苹果汁

正确答案：C。小麦和玉米

解析：本题考查镰刀菌毒素主要污染的食品。镰刀菌毒素主要污染的食品是麦类、玉米及其制品（C对ABDE错）。